女性，20岁。颌面部跌伤4小时。无昏迷史，脉搏、血压、呼吸均正常。口腔检查：上唇有一个2cm长的穿通伤口，上2-2牙龈撕裂，轻摇之有骨块异常活动。下颌检查未见异常。后牙咬合关系正常，张口未受限。上唇伤口缝合方法正确的是
A. 先缝皮肤再缝黏膜
B. 先缝肌层，再缝皮肤，最后缝黏膜
C. 先关闭口腔黏膜创口，再缝肌层，缝皮肤
D. 因唇部组织不厚，可黏膜、肌层、皮肤一起缝
E. 以上方法均可行

正确答案：C。先关闭口腔黏膜创口，再缝肌层，缝皮肤

解析：本题考查上唇伤口缝合方法。唇部伤口缝合时应遵循从内至外的原则，防止口腔内细菌感染创口，因此，正确做法是先关闭口腔黏膜创口，再缝肌层，缝皮肤（C对）。